某地区欲找出对病人生命威胁最大的疾病，以便制定防治对策，需要计算和评价的统计指标为
A. 病死率
B. 患病率
C. 死亡率
D. 患病构成比
E. 发病率

正确答案：A。病死率

解析：某种疾病的病死率（A对）可以帮助分析出一个地区对病人生命威胁最大的疾病，以便制定防治对策。患病率（B错）主要用来描述病程较长的慢性病的发生或流行情况，没有分析死亡因素。死亡率（C错）偏重于全部死亡者，常用于评价不同医院的诊疗水平，而不是侧重的研究某一种疾病对生命的威胁。患病构成比（D错）主要用于分析某地区各种疾病的发生占比情况，没有分析死亡因素。同样发病率（E错）也不是研究死亡者所占比率的数据。